金-瓷结合的主要机制是
A. 化学结合
B. 压缩结合
C. 范德华力
D. 机械结合
E. 氢键结合

正确答案：A。化学结合

解析：有关金-瓷结合的机制至今仍未定论，但至少有四种结合理论被广泛接受：①化学结合；②机械结合；③压缩结合；④范德华力。其中，化学结合被大多数研究者认为是金-瓷结合中最主要，最关键的结合机制。掌握“修复材料、金瓷结合及树脂粘结机制”知识点。